新生儿娩出后首先应
A. 断脐
B. 擦洗新生儿面部
C. 清理呼吸道
D. 刺激新生儿足部
E. 抓紧娩出胎盘及胎膜

正确答案：C。清理呼吸道

解析：新生儿娩出后的处理步骤为：清理呼吸道（C对）→处理脐带（A错）→阿普加评分→擦洗新生儿（B错）→协助胎盘娩出（E错）。新生儿娩出后首先清理呼吸道，当确认呼吸道通畅而未啼哭时，可用手刺激新生儿足底（D错），新生儿大哭后处理脐带。